X线片示双手指间关节间隙狭窄，双侧腕骨可见骨质吸收破坏，间隙变窄，该患者腕关节病变影像学分期为
A. I
B. II
C. III
D. IV
E. V

正确答案：C。III

解析：该患者女，55岁，间断多关节肿痛8年，近3年双腕关节活动逐渐受限，长期服用泼尼松10mg/d治疗。X线片示双手指间关节间隙狭窄，双侧腕骨可见骨质吸收破坏（可出现虫蚀样改变），间隙变窄，结合患者的表现，提示为腕关节病变影像学III期（C对ABD错）。E选项不属于腕关节病变影像学分期（E错）。